肺炎喘嗽与支气管炎区别的重要体征是
A. 双肺固定的细湿啰音
B. 双肺呼吸音减弱
C. 双肺呼吸音增粗
D. 双肺哮鸣音
E. 双肺管状呼吸音

正确答案：A。双肺固定的细湿啰音

解析：肺炎（中医称之为肺炎喘嗽）其诊断为临床上有发热、咳嗽、气促或呼吸困难的症状，肺部有较固定的中、细湿啰音，胸片有斑片影，可协助诊断；急性支气管炎以咳嗽为主，一般无发热或仅有低热，肺部听诊呼吸音粗糙或有不固定的干湿啰音（A对）。双肺呼吸音减弱（B错）可见于双侧气胸、妊娠晚期、低钾血症等。双肺呼吸音增粗（C错）见于支气管或肺部炎症的早期。双肺哮鸣音（D错）为支气管哮喘的重要体征。双肺管状呼吸音（E错）为在正常肺泡呼吸音分布的区域内听到了支气管呼吸音，见于肺组织实变、肺内大空洞和压迫性肺不张。